男，30岁，低热、盗汗，咳嗽、血痰一月。胸片示右上肺小片状浸润影，密度不均。确诊应选择的检查是
A. PPD试验
B. 痰TB-DNA
C. 血清中结核抗体
D. 痰检抗酸杆菌
E. 血沉

正确答案：D。痰检抗酸杆菌

解析：患者为中青年男性，低热，盗汗，咳嗽，血痰（为肺结核的典型临床表现），胸片示右上肺小片状浸润影，密度不均，根据其临床表现和辅助检查，考虑诊断为肺结核，确诊应选择的检查是痰检抗酸杆菌（D对）。痰检抗酸杆菌是确诊肺结核病的主要方法，也是制订化疗方案和考核治疗效果的主要依据，每一个有肺结核可疑症状或肺部有异常阴影的患者都必须查痰。PPD试验（A错）（P66）广泛应用于检出结核分枝杆菌的感染，而非检出结核病，且阳性不能区分是结核分枝杆菌的自然感染还是卡介苗接种的免疫反应，仅对儿童、少年和青年的结核病诊断有参考意义。痰T-DNA（B错）阳性率并不高，不是最常用的结核检查。血清中结核抗体（C错）只能检测出曾经感染过结核分枝杆菌，并不能确诊结核病，一般不用于临床结核病的诊断。血沉（E错）一般只用于了解病情的活动性，不作为疾病诊断的标准。